根据《城镇职工医疗保险用药范围管理暂行办法》，《基本医疗保险药品目录》的“甲类目录”和“乙类目录”均有列入的药品是
A. 中成药
B. 中药饮片
C. 口服泡腾剂
D. 血液制品
E. 中药材

正确答案：A。中成药